一患者左侧面颊因交通外伤，当时采用药敷，一天后揭开发现伤至骨面，并伴有活动性出血。当时要采用什么止血
A. 包扎
B. 结扎
C. 填塞
D. 压迫
E. 缝合

正确答案：B。结扎

解析：本题考查口腔颌面部损伤患者的急救。结扎止血是常用而可靠的止血方法。患者左侧面颊因交通外伤，采用药敷一天后揭开发现伤至骨面，并伴有活动性出血。当时要采用结扎（B对）止血。包扎（A错）止血法：可用于毛细血管、小静脉及小动脉的出血，或创面渗血。填塞（C错）止血法：可用于开放性和洞穿性创口，也可用于窦腔出血。压迫（D错）止血法：是一种不确切而且临时的止血方法，对于较大血管的出血，还需要作进一步的处理。包括指压止血法、包扎止血法、填塞止血法。缝合（E错）止血法：多用于钳夹的组织过多，结扎有困难或线结容易滑脱时。